患儿男，5岁，便血，排便时可见单个鲜红色樱桃样肿物脱出，便后可自行回纳应首先考虑的是
A. 肛管直肠周围脓肿
B. 内痔
C. 直肠息肉
D. 血栓性外痔
E. 肛瘘

正确答案：C。直肠息肉

解析：患者为5岁儿童，便血，且有鲜红肿物脱出，易回纳，均符合直肠息肉诊断（C对）。肛管直肠周围脓肿常有症状为：肛门周围出现了一个小硬块或肿块，继而疼痛加剧、红肿发热、坠胀不适、坐卧不宁、夜不能眠、大便秘结、排尿不畅成里急后重等直肠刺激症状。并随之出现全身不适、精神疲惫乏力、体温升高、食欲减退、寒战高热等全身中毒症状（A错）。内痔多发于成年人，初发常以无痛性便血为主要症状，血液与大便不相混，多在排便时滴血或射血。出血呈间歇性，每因饮酒、过劳、便秘或腹泻时使便血复发和加重。出血严重时可引起贫血。肛查时见齿线上粘膜呈半球状隆起，色鲜红、暗红或灰白（B错）。血栓性外痔多在排便或剧烈活动后，感到肛门有突起的肿块，疼痛剧烈，活动受限，甚至坐卧不安。肛缘皮下有一触痛性肿物，排便、坐下、行走甚至咳嗽等动作均可使疼痛加剧。检查可见肛周或肛管皮下有葡萄状暗紫色肿物，有时伴表面轻度糜烂出血（D错）。肛瘘主要表现为1.流脓 周期性发作，时有时无，脓液较少。2.肿痛 一般不疼，当脓液积存于管腔内引流不畅时，局部胀痛，当脓液流出后疼痛马上减轻。3.肿块 大部分患者可在肛缘触及索条状硬块，按压轻度疼痛。4.瘙痒 脓液经常刺激瘘口周围皮肤，致肛门皮肤瘙痒或湿疹（E错）。